引起生殖器疣的病毒是
A. HPV
B. HSV
C. HIV
D. HBV
E. 巨细胞病毒

正确答案：A。HPV

解析：本题考查常见性传播疾病及其病原体。引起生殖器疣的病毒是HPV（A对BCDE错），即人类乳头瘤病毒，主要相关疾病有：阴茎和肛门疣；外阴、肛门和宫颈疣、宫颈癌、外阴癌、肛门癌等。